患儿，4岁。脐周腹痛，时作时止，面色萎黄，日渐消瘦，恶心呕吐，大便排出蛔虫1条，寐中磨牙，其治疗首选的方剂是
A. 乌梅丸加减
B. 舟车丸加减
C. 化食丸加减
D. 保和丸加减
E. 使君子散加减

正确答案：E。使君子散加减

解析：蛔虫寄生小肠内，扰乱脾胃气机，吸食水谷精微，故可见面色萎黄，日渐消瘦等气血不足之证。虫聚肠内，故见脐周腹痛，时作时止。脾胃失和，故见恶心呕吐。湿浊内生，熏蒸于上，可见寐中磨牙（E对）。乌梅丸具有缓肝调中，清上温下之功效。用于治疗蛔厥，久痢，厥阴头痛，症见腹痛下痢、巅顶头痛、时发时止、躁烦呕吐、手足厥冷（A错）。舟车丸行气利水，用于蓄水腹胀，四肢浮肿，胸腹胀满，停饮喘急，大便秘结，小便短少（B错）。化食丸用于小儿胃热停食，肚腹胀满，恶心呕吐，烦躁口渴，大便干燥（C错）。保和丸消食，导滞，和胃。用于食积停滞，脘腹胀满，嗳腐吞酸，不欲饮食（D错）。